高血压脑出血最好发的部位是
A. 脑室
B. 内囊和基底节附近
C. 丘脑
D. 脑桥
E. 小脑

正确答案：B。内囊和基底节附近

解析：高血压脑出血最好发的部位是内囊和基底节附近（B对），内囊和基底节附近出血约占高血压脑出血（ICH）的70%。脑室（D错）出血约占ICH的3%-5%。丘脑（A错）出血约占ICH的10%-15%。脑桥（D错）出血和小脑（E错）出血均约占脑出血的10%。